关于药品监督检查的说法错误的是
A. 药品经营监督检查分为许可检查、跟踪检查和有因检查，实施检查时可以采取飞行检查、延伸检查等方式
B. 任何单位和个人都不得拒绝、逃避药品监督管部门进行的监督检查
C. 省级药品监督管理部门应当依职责对辖区内药品上市许可持有人实施药品生产、经营质量管理规范的情况开展监督检查
D. 对于委托销售、储存、运输跨区域实施的，委托方、受托方所在地药品监督管理部门应当加强信息沟通，及时通报监督检查情况

正确答案：A。药品经营监督检查分为许可检查、跟踪检查和有因检查，实施检查时可以采取飞行检查、延伸检查等方式

解析：本题考查的是药品经营监督检查分类与方式。关于药品监督检查的说法错误的是药品经营监督检查分为许可检查、跟踪检查和有因检查，实施检查时可以采取飞行检查、延伸检查等方式（A错，为本题正确答案）。药品经营监督检查包括许可检查、常规检查和有因检查；按照药品监督检查相关规定，可采取飞行检查、延伸检查、委托检查、联合检查等方式。省级药品监督管理部门依据《药品经营监督管理办法》、药品GSP及其现场检查指导原则制定检查细则，承担本行政区域内药品批发企业、药品零售连锁经营企业总部、药品网络交易第三方平台的监督管理以及药品上市许可持有人批发行为的监督管理工作，并负责指导市县的药品经营监督管理工作（C对）。对于药品上市许可持有人、药品经营企业跨省委托销售、储存、运输的，由委托方所在地省级药品监督管理部门负责监督管理，受托方所在地省级药品监督管理部门予以配合。委托方、受托方所在地省级药品监督管理部门应当加强信息沟通，及时将备案管理和监督检查情况通报对方（D对）。任何单位和个人不得以任何理由逃避、拒绝药品监督管理部门实施药品经营监督检查（B对）。